中国药典规定菊花产地、加工方法不同
A. 亳菊
B. 滁菊
C. 贡菊
D. 杭菊
E. 野菊花

正确答案：A、B、C、D。亳菊；滁菊；贡菊；杭菊

解析：本题考查的是菊花的来源。中国药典规定菊花产地、加工方法不同亳菊（A对）、滁菊（B对）、贡菊（C对）、杭菊（D对）。菊花【来源】为菊科植物菊的干燥头状花序。药材按产地和加工方法不同，分为“亳菊”“滁菊”“贡菊”“杭菊”“怀菊”。